男，40岁。骤起高热，畏寒，体温39℃，持续3天，头痛、腰痛、眼眶痛，颜面、颈、上胸潮红，球结膜、咽部、舌质充血鲜红，同时伴有纳差、恶心、腹痛，腋下、上胸部、颈部、后背部皮肤有点状出血点。血清特异性抗体IgM阳性。应考虑
A. 慢性支气管炎
B. 流行性脑脊髓膜炎
C. 流行性出血热
D. 肺结核
E. 伤寒

正确答案：C。流行性出血热

解析：特异性免疫球蛋白（IgM）是诊断流行性出血热简便而可靠的依据，且有早期诊断价值，IgM抗体在病后1～3天即可检出（1：20为阳性），至发热后期其阳性率最高，持续3个月至半年逐渐消失。本例患者骤起高热，畏寒，持续发热，伴有头痛、腰痛、眼眶痛"三痛"征，以及颜面、颈、上胸潮红"三红"征，球结膜、咽部、舌质充血鲜红，同时伴有纳差、恶心、腹痛，腋下、上胸部、颈部、后背部皮肤有点状出血点，应考虑流行性出血热（C对）。慢性支气管炎（A错）主要临床表现为咳嗽、咳痰，或有喘息，每年发病持续3个月或更长时间，连续两年或两年以上；流行性脑脊髓膜炎（B错）主要临床表现为突发高热、剧烈头痛、频繁呕吐、皮肤黏膜瘀点及脑膜刺激征，脑脊液呈化脓性改变；肺结核（C错）临床多呈慢性过程，表现为长期低热、咳嗽、咳痰、咯血等；伤寒（E错）临床表现为持续性发热、表情淡漠、相对缓脉、玫瑰疹、肝脾肿大及白细胞减少等，以上均无典型的"三痛"征、"三红"征、IgM阳性等，故不考虑该诊断。